需要与妊娠晚期合并急性病毒性肝炎鉴别不包括
A. 妊娠剧吐引起的肝损害
B. 妊娠期高血压引起的肝损害
C. 妊娠期急性脂肪肝
D. 药物性肝损害
E. 妊娠综合征

正确答案：E。妊娠综合征

解析：需要与妊娠晚期合并急性病毒性肝炎鉴别的包括：妊娠期急性脂肪肝（C对），与妊娠期高血压疾病引起的肝损害（B对）如溶血、肝酶升高和血小板减少综合征（HELLP综合征）、妊娠期肝内胆汁淤积症、妊娠剧吐引起的肝损害（A对）、药物性肝损害（D对）等疾病。故需要与妊娠晚期合并急性病毒性肝炎鉴别不包括妊娠综合征（E错，为本题正确答案）。